应用麻醉药利多卡因时宜
A. 适当多食脂肪
B. 少食盐
C. 少食醋
D. 不吸烟
E. 不饮酒

正确答案：D。不吸烟

解析：本题考查饮食对药物疗效的影响。应用麻醉药利多卡因时宜不吸烟（D对）。烟草中含有大量的多环芳香烃类化合物，可增加肝药酶活性，同时，吸烟可使人对利多卡因的敏感性降低，药效变差。脂肪对药效有双重作用，既能降低某些药物的疗效，也能增加某些药物的疗效（A错）。食盐可影响血液的容量和渗透压（B错）。食醋的成分为醋酸，若与碱性药及中性药同服，可发生酸碱中和反应，使药物失效（C错）。酒（E错）的主要成分是乙醇，能够降低药效或增加发生不良反应的几率，但对利多卡因影响不大。